患者，女，17岁。面、鼻部粉刺，用手指挤压，有米粒样白色脂栓挤出，颜面潮红，舌红苔薄黄，脉细数。证属肺经风热，治疗应首选
A. 枇杷清肺饮
B. 桑菊饮
C. 银翘散
D. 消风散
E. 防风通圣散

正确答案：A。枇杷清肺饮

解析：粉刺，是一种以颜面、胸、背等处生丘疹如刺，可挤出白色碎米样粉汁为主要临床表现的皮肤病，相当于西医的痤疮，是毛囊、皮脂腺的慢性炎症，临床辨证分型为肺经风热证、肠胃湿热证和痰湿瘀滞证，本病例明确诊断为粉刺，属肺经风热证，治法为疏风清肺，方药为枇杷清肺饮（A对）。桑菊饮，具有疏风清热、宣肺止咳的作用，用于风温咳嗽轻证（B错）。银翘散，具有疏风清热的作用，用于疮疡焮红肿痛，邪气在表，头昏少汗，发热重、恶寒轻者（C错）。消风散，具有散风、清热、凉血、利湿的作用，用于风疹块、疮疡因风湿血热所致者（D错）。防风通圣散，具有解表通里、散风清热、化湿解毒的作用，用于内郁湿热，外感风寒，表里同病，属于气血实者（E错）。